产褥期产妇乳房的主要变化是
A. 乳房增大
B. 乳汁的产生
C. 射乳
D. 泌乳
E. 乳房充血明显

正确答案：D。泌乳